防己的主治证是
A. 风湿热痹证
B. 水肿证
C. 二者均是
D. 二者均不是

正确答案：C。二者均是

解析：本题考查的是防己的主治病证。防己的主治证是风湿热痹证与水肿证（C对）。防己：【主治病证】（1）风湿痹痛（A错），尤以热痹为佳。（2）水肿（B错），腹水，脚气浮肿，小便不利。